下列辅料中，可作为胶囊壳遮光剂的是
A. 明胶
B. 羧甲基纤维素钠
C. 微晶纤维素
D. 硬脂酸镁
E. 二氧化钛

正确答案：E。二氧化钛

解析：本题考查片剂的包衣。二氧化钛（E对）为胶囊壳常用的遮光剂；明胶（A错）、羧甲基纤维素钠（B错）均为片剂黏合剂；微晶纤维素（C错）为片剂稀释剂；硬脂酸镁（D错）为片剂润滑剂。